肌肉活动依靠体内贮存的ATP-CP系统供能的特点是
A. 缓慢
B. 产生乳酸较多
C. 非常迅速
D. 提供能量较多
E. 氧的需要量较少

正确答案：C。非常迅速